沿腹中线旁开0.5寸，胸中线旁开2寸，到达锁骨下缘的经脉是
A. 足阳明胃经
B. 手太阴肺经
C. 足少阴肾经
D. 足太阴脾经
E. 足厥阴肝经

正确答案：C。足少阴肾经

解析：本题考查肾经在腹部的循行路线。足阳明胃经外行部分循行与胸腹第二侧线，抵腹股沟处，下循下肢外侧前缘，止于第二趾外侧端（A错）。手太阴肺经外行线起于侧胸上部，循行于上肢内侧前缘，经过寸口，止于拇指桡侧段（B错）。足少阴肾经另有分支向上行于腹部前正中线旁0.5寸，胸部前正中线旁2寸，止于锁骨下缘（C对）。足太阴脾经一条分布于胸腹部第三侧线，经锁骨下，止于腋下大包穴另一条起于足大趾，循行于小腿内侧的中间，止于舌（D错）。 足厥阴肝经起于足大趾外侧，经足背、内踝前上行于大腿内侧，联系阴部，入体腔，联系于胃、肝、胆、膈、胁肋，经咽喉上联目系，上行出于额部，与督脉交会与颠顶部（E错）。